全口义齿初戴，侧方（牙合）选磨，通常应调整
A. 上尖牙
B. 上前牙
C. 下尖牙
D. 下前牙
E. 上后牙

正确答案：C。下尖牙

解析：本题考查侧方（牙合）的选磨。侧方（牙合）的选磨原则是：选磨少数有蓝（牙合）印的非支持尖上的（牙合）干扰点，每次只选磨单颌，换咬合纸检查，反复选磨，直到所有非支持尖都有接触点位置。另外，侧方（牙合）选磨时要特别注意上下尖牙的干扰，妨碍侧方（牙合）运动的进行。选磨部位为下尖牙的唇斜面或上尖牙的舌斜面，通常以选磨下尖牙（C对）为主。偶尔也可选磨上尖牙，但选磨上尖牙时不可选磨过多而短于上切牙（A错）。选磨上前牙（B错）、下前牙（D错）见于选磨前牙接触而后牙不接触的前伸（牙合）干扰情况。选磨上后牙（E错）牙尖的远中斜面或下后牙牙尖的近中斜面见于后牙接触而前牙不接触的前伸（牙合）干扰情况。